P:90次／分。血压：108/80mmHg。胎心：120次／分。以下处理措施哪项是错误的
A. 检测胎心
B. 急诊剖腹产
C. 必要时输血
D. 促胎肺成熟
E. 预防感染

正确答案：B。急诊剖腹产

解析：青年女性，妊娠晚期有少量阴道流血（前置胎盘的典型表现为妊娠晚期无痛性阴道流血），可初步诊断为前置胎盘，另外该孕妇妊娠32周（＜34周），应采取期待疗法，抑制宫缩以延长孕周和促胎肺成熟（D对B错，为本题正确答案），监测胎心（A对）；密切观察阴道流血量， 监护胎儿宫内状况；维持正常血容量，必要时输血（C对）；出血多预防感染（E对）。